《温病条辨》中指出：温病邪在阳明久羁，或已下，或未下，身热面赤，口干舌燥，甚则齿黑唇裂，决定使用下法或滋肾法的主要依据是
A. 口渴或口不渴
B. 脉沉实或脉虚大，手足心热甚于手足背
C. 发热或不发热
D. 恶寒或不恶寒
E. 烦躁或不烦躁

正确答案：B。脉沉实或脉虚大，手足心热甚于手足背

解析：吴氏强调“温邪久羁中焦，阳明阳土，未有不克少阴癸水者”。阳明热盛日久，若脉沉实，并见身热面赤，口干舌燥，甚则齿黑唇裂，仍属阳明腑实之证，治疗仍当用攻下之法；若脉虚大，手足心热甚于手足背，乃温病后期，邪入下焦，耗伤真阴所致，属肾阴大伤之证，当用加减复脉汤以滋养肾阴（B对）。